痛风急性期患者限制嘌呤摄入的要求正确的是
A. 自由选择低嘌呤含量的食物，适当选择中等嘌呤含量的食物
B. 嘌呤的摄入量应限制在200mg/d之内
C. 可适当食用动物肝脏、肉汁、肉汤等
D. 蛋白质每天摄入应在50～80g
E. 每日食盐量不超过6g

正确答案：E。每日食盐量不超过6g